心衰患者出现端坐呼吸后的病生变化是
A. 端坐体位迷走神经兴奋性增高
B. 端坐时回心血量增多
C. 端坐时机体缺氧加剧
D. 端坐时减轻肺淤血
E. 端坐时隔肌位置相应上移

正确答案：D。端坐时减轻肺淤血

解析：患者静息时出现呼吸困难，平卧时加重，需被迫采取端坐位以减轻呼吸困难。端坐位时，下肢血液回流减少，同时水肿液吸收减少，因而回心血量减少（B错），肺淤血减轻（D对）。另外，端坐位时膈肌位置相应下移（E错），胸腔容积增大，肺活量增加，缺氧缓解（C错）。